患者，男，66岁，患高血压、功能性便秘，服用硝苯地平控释片、双歧杆菌三联活菌胶囊。关于该患者用药教育的说法，错误的是
A. 硝苯地平控释片不可掰开服用
B. 大便中可能会看到硝苯地平控释片的完整片形
C. 双歧杆菌三联活菌胶囊应于阴凉处保存
D. 双歧杆菌三联活菌胶囊避免与抗菌药物、双八面体蒙脱石散同时服用
E. 双歧三联活菌胶囊不能用超过40℃的水送服

正确答案：C。双歧杆菌三联活菌胶囊应于阴凉处保存

解析：本题考查便秘患者用药教育。双歧三联活菌胶囊需要在冷处贮存（C错，为本题正确答案）。硝苯地平控释片（拜新同）为控释制剂不宜掰开或嚼碎服用（A对），且服用后，药物骨架不能被吸收，会随粪便排出体外（B对），而排出体外的缓、控释结构酷似完整药片。有些药物不能和其他药物同时服用，如多维乳酸菌、枯草杆菌-肠球菌二联活菌（美常安）、双歧杆菌-嗜酸乳杆菌-肠球菌三联活菌（培菲康）等活菌制剂不能和抗菌药物同服，因为抗菌药物能降低活菌活性，所以需间隔服用；蒙脱石散剂具有吸附作用，可影响其他药物疗效，因此与其他口服药物也需间隔服用（D对）。活菌制剂如多维乳酸菌、枯草杆菌-肠球菌二联活菌（美常安）、双歧杆菌-嗜酸乳杆菌-肠球菌三联活菌（培菲康）等不能用超过40℃的水送服（E对）。